釉质中有机质占总重量的1%，其中基质蛋白主要包括
A. 白蛋白和成釉蛋白
B. 球蛋白和釉丛蛋白
C. 白蛋白和釉丛蛋白
D. 球蛋白和釉原蛋白
E. 釉原蛋白和非釉原蛋白

正确答案：E。釉原蛋白和非釉原蛋白

解析：釉质中的有机物约占总重量的1%，主要由蛋白质和脂类所组成。基质蛋白主要有釉原蛋白、非釉原蛋白和蛋白酶等三大类。非釉原蛋白包括釉蛋白、成釉蛋白和釉丛蛋白等。白蛋白是一种广泛分布在各种动植物中的蛋白质，在人体血液，组织液中含有白蛋白，它最重要的作用是维持胶体渗透压。釉质中不包含白蛋白，也不包含球蛋白。掌握“牙釉质”知识点。